流行性脑脊髓膜炎抗菌治疗，首选的药物是
A. 青霉素
B. 阿奇霉素
C. 氯霉素
D. 环丙沙星
E. 复方新诺明

正确答案：A。青霉素

解析：流行性脑脊髓膜炎抗菌治疗，首选的药物是青霉素（A对）。阿奇霉素主要用于化脓性链球菌引起的急性咽炎、急性扁桃体炎（B错）。氯霉素主要用于伤寒、副伤寒的治疗（C错）。环丙沙星主要用于尿路感染、细菌性痢疾的治疗（D错）。复方新诺明主要用于尿路感染、急性中耳炎的治疗（E错）。